下列哪项方法不宜用于闭经与早孕的鉴别
A. 妇科检查
B. 基础体温测定
C. 尿妊娠试验
D. 腹部X线检查
E. B超检查

正确答案：D。腹部X线检查

解析：闭经是一个可由多种原因造成的月经暂时或永久停止的临床症状。传统上将闭经分成原发性和继发性，18岁作为诊断的界限。早孕（早期妊娠）是指生育年龄的女性，有性生活史，平时月经周期规则，出现月经过期10天或以上或停经，怀孕的时间在怀孕13周末之前。早孕时，停经后基础体温测定升高（B对），随着妊娠进展，子宫逐渐增大，妇科检查（A对）手测子宫底高度或尺测耻上子宫高度，可以判断子宫大小与妊娠周数。B型超声检查（E对）是检查早期妊娠快速而准确的方法。孕卵着床后滋养细胞分泌hCG，并经孕妇尿中排出的原理，用早孕试纸法检测尿液（C对），若为阳性，结合临床表现可确诊妊娠。腹部X线检查（D错，为本题正确答案）有辐射性，不适合早孕的诊断。